与胰岛素合用治疗高钾血症的药物是
A. 碳酸钙
B. 三磷酸腺苷
C. 二磷酸果糖
D. 葡萄糖
E. 螺内酯

正确答案：D。葡萄糖

解析：本题考查葡萄糖。与胰岛素合用治疗高钾血症的药物是葡萄糖（D对）。葡萄糖临床可用于高钾血症，胰岛素能降糖，两者可配合使用防止血糖升高。